APC提呈外源性Ag的正确描述是
A. 外源性Ag可在局部或局部引流至淋巴组织接触APC
B. 外源性Ag首先被APC摄取、加工和处理
C. 外源性Ag通常被APC以抗原肽-MHCⅠ类分子复合物形式提呈给CD8⁺T细胞识别
D. 上列A和B两项
E. 上列A、B和C三项

正确答案：D。上列A和B两项